男，35岁。腰背部疼痛3个月，伴有乏力、盗汗。查体：双下肢感觉、运动功能正常。X线显示L₂₋₃椎间隙狭窄，腰大肌影增宽。最适宜的治疗方法是
A. 抗结核药物治疗
B. 局部注射抗炎药物
C. 腰背部理疗按摩
D. 加强腰背肌锻炼
E. 立即行病灶清除手术

正确答案：A。抗结核药物治疗

解析：青年男性患者，腰背部疼痛，伴有乏力、盗汗（提示可能有结核杆菌感染），双下肢感觉运动功能正常（提示无脊髓、神经受压表现），X线示L2～3椎间隙狭窄（腰椎结核的影像学表现），腰大肌影增宽（流注脓肿表现），结合患者症状、体征和影像学表现，该患者最可能的诊断为腰椎结核。患者腰大肌影增宽，提示合并腰大肌寒性脓肿，应行手术治疗。术前需规范化应用抗结核药物4～6周以控制混合感染，故该患者最适宜的治疗方法是抗结核药物治疗（A对）。腰椎结核为结核杆菌引起的特异性感染，普通抗炎药物治疗无效，因此不能采用局部注射抗炎药物（B错）治疗。腰背部理疗按摩（C错）和加强腰背肌锻炼（D错）均为非手术治疗措施。病灶清除手术（E错）需在抗结核化疗后进行。